环境毒理学研究方法的理论基础是建立在
A. 卫生毒理学方法上
B. 动物实验基础上
C. 时间与反应关系上
D. 物质蓄积性基础上
E. 剂量-反应（效应）关系上

正确答案：A。卫生毒理学方法上

解析：本题考查环境毒理学研究方法的理论基础。环境毒理学是一门研究人类及其环境之间毒性物质的关系的学科，其核心是人类与环境毒物之间的关系。其研究方法基于卫生毒理学（A对BCDE错），是以人体健康为核心，研究人类及其环境之间毒性物质的关系的学科。